不属于钩端螺旋体病后发症的是
A. 后发热
B. 虹膜睫状体炎
C. 反应性脑膜炎
D. 肾损害
E. 闭塞性脑动脉炎

正确答案：D。肾损害

解析：后发热（A对）急性期发热经治疗或自然下降后，发热再次出现，一般多于体温下降正常1～5天后出现，大多在38℃左右。眼后发症（B对）多于急性期退热后1周至1个月左右出现，可表现为巩膜外层炎，球后视神经炎，玻璃体浑浊，葡萄膜炎等，但以葡萄膜炎为常见。反应性脑膜炎（C对）少数患者后发热同时出现脑膜炎表现，但脑脊液钩体培养阴性，预后良好。不属于钩端螺旋体病后发症的是肾损害（D错，为本题正确答案），它是钩体病中期黄疸出血型的临床表现，肾衰竭为病人主要致死原因。闭塞性脑动脉炎（E对）多于退热后半个月至5个月出现，表现有突然出现偏瘫，失语或多次反复短暂性肢体瘫痪等。